每毫升11.2%乳酸钠含HCO₃⁻
A. 0.2mmol
B. 0.6mmol
C. 1.0mmol
D. 1.5mmol
E. 2.0mmol

正确答案：C。1.0mmol

解析：每毫升11.2%乳酸钠含112mg乳酸钠，乳酸钠的摩尔质量为112g/mol，故每毫升液体内含乳酸钠1mmol。每个乳酸钠经代谢可产生一个HCO₃⁻，故每毫升11.2%乳酸钠中HCO₃⁻含量为1mmol（C对）。